慢性肾功能衰竭晚期钙磷代谢障碍表现为
A. 血磷降低，血钙升高
B. 血磷升高，血钙降低
C. 血磷正常，血钙升高
D. 血磷升高，血钙正常
E. 血磷降低，血钙降低

正确答案：B。血磷升高，血钙降低

解析：慢性肾功能衰竭晚期钙磷代谢障碍表现为血磷升高，血钙降低（B对）。